患者，男，38岁，1天前骑自行车跌倒，上前牙受伤，现咬合疼。检查：左上1牙冠完整，叩（+），电活力测验无反应，松动Ⅰ度，牙龈无红肿，X线片示根尖1/3处有根折线。该牙的处理应为
A. 调（牙合）、固定
B. 立即做根管治疗术
C. 立即做根尖切除术
D. 不做任何处理
E. 拔除患牙

正确答案：A。调（牙合）、固定

解析：根尖1/3处根折的牙应该先调（牙合）、固定。有牙髓症状的再做根管治疗，根管治疗失败了才拔除。掌握“牙折”知识点。